按照分散系统进行分类，药物剂型可分为
A. 溶液型
B. 胶体溶液型
C. 固体分散型
D. 乳剂型
E. 混悬型

正确答案：A、B、C、D、E。溶液型；胶体溶液型；固体分散型；乳剂型；混悬型

解析：本题考查药物剂型的分类。按照分散系统进行分类，药物剂型可分为溶液型（A对）、胶体溶液型（B对）、固体分散型（C对）、乳剂型（D对）、混悬型（E对）、气体分散型和微粒型。